男性，易怒、多汗、饥饿，体温：40℃，此时处理不适宜的是
A. 用阿司匹林降温
B. 行物理降温
C. 糖皮质激素
D. 丙基氧硫嘧啶
E. 碘剂

正确答案：A。用阿司匹林降温

解析：该患者男性，易怒、多汗、饥饿，体温：40℃，结合患者的表现，考虑为甲状腺危象，在高热时，应给予物理降温（B对），避免用乙酰水杨酸类药物（A错，为本题的正确答案）；可给予糖皮质激素防止和纠正肾上腺皮质功能减退（C对）；抗甲状腺药物抑制甲状腺激素合成和抑制外周组织T4向T3转换（D对）；复方碘溶液抑制甲状腺激素释放（E对）。